女性，20岁。左侧上颌后牙自发性肿痛，吸吮时出血3天。4天前曾有过鱼刺刺伤史。口腔检查26、27牙间探诊疼痛明显，牙龈乳头红肿，叩诊（+），无松动，未探及牙周袋。诊断为
A. 慢性龈炎
B. 慢性牙周炎
C. 侵袭性牙周炎
D. 急性牙髓炎
E. 急性龈乳头炎

正确答案：E。急性龈乳头炎

解析：本题考查牙周炎的鉴别。患者左侧上颌后牙自发性肿痛（明显自发痛），吸吮时出血3天（易出血）。4天前曾有过鱼刺刺伤史（过锐食物的刺伤）。口腔检查26、27牙间探诊疼痛明显（探触痛明显），牙龈乳头红肿，叩诊（+）（有叩痛），无松动，未探及牙周袋（排除牙周炎），符合急性龈乳头炎（E对）的临床表现。治疗时需去除刺激因素，消除急性炎症，局部使用抗菌消炎药物。慢性龈炎（A错）龈乳头为鲜红或暗红色、圆钝肥大，一般无自发性出血，部分患者以牙龈组织的炎性肿胀为主要表现，可感到牙龈局部痒、胀、不适，有口臭等症状。慢性牙周炎（B错）患者可有刷牙或进食时的牙龈出血或口内异味，牙龈表现为鲜红或暗红色，水肿松软，并可有不同程度的肿大甚至增生。患牙探诊有＞3mm的牙周袋，并有探诊后出血，甚至溢脓。侵袭性牙周炎（C错）早期无明显症状，牙周组织破坏程度与局部刺激物的量不成比例，炎症不明显时可出现牙齿松动和移位，有严重而快速的附着丧失和牙槽骨破坏。急性牙髓炎（D错）主要症状是自发性阵发性的剧烈疼痛，有夜间痛，温度刺激加剧，呈放散痛，不能自行定位。